维生素K缺乏时，不会出现的实验室检查结果是
A. PT延长
B. FDP增加
C. CT延长
D. INR升高
E. APTT延长

正确答案：B。FDP增加

解析：FDP为Fbn和Fbg被PLn（纤溶酶）水解后可生成各种大小不同的多肽片段。FⅡ、FⅦ、FIX、FX的生成需要维生素k的参与，维生素K缺乏时可导致内源性及外源性凝血异常。PT、CT、APTT延长，INR升高（ACDE对）。FDPs阳性或增高见于原发性纤溶和继发性纤溶（B错，为本题正确答案）。